HCO₃⁻原发性降低见于
A. 代谢性酸中毒
B. 呼吸性酸中毒
C. 代谢性碱中毒
D. 呼吸性碱中毒
E. 酸碱平衡正常

正确答案：A。代谢性酸中毒

解析：HCO₃⁻原发性降低见于代谢性酸中毒（A对），这是由于HCO₃⁻丢失过多，或者HCO₃⁻因中和体内过多固定酸而下降。